治疗肾盂肾炎湿热下注证，应首选
A. 知柏地黄汤
B. 猪苓汤
C. 程氏萆薢分清饮
D. 八正散
E. 真武汤

正确答案：D。八正散

解析：八正散可以清热利湿通淋，故用于治疗肾盂肾炎湿热下注证（D对）。知柏地黄汤（A错）用于阴虚证。猪苓汤（B错）用于水热互结证。程氏萆薢分清饮（C错）用于膏淋。真武汤（E错）用于阳虚水泛证。